女性，46岁，乏力纳差，一直素食，血液检查：Hb:74g/L，MCV:124fl，MCHC:32-35g/L。最可能的诊断是
A. 巨幼细胞性贫血
B. 再生障碍性贫血
C. 缺铁性贫血
D. 海洋性贫血
E. 急性白血病

正确答案：A。巨幼细胞性贫血

解析：患者女性，46岁，乏力纳差，素食主义者（巨幼细胞性贫血Vit B₁₂缺乏的原因），血液检查：Hb:74g/L，MCV:124fl（MCV＞100fl），MCHC:32-35g/L，提示大细胞性贫血，最可能的诊断是巨幼细胞性贫血（A对）。再生障碍性贫血诊断标准 ①全血细胞减少，网织红细胞百分数＜0.01,淋巴细胞比例增高；②一般无肝、脾大；③骨髓多部位增生减低（＜正常50 %) 或重度减低(＜正常25 %), 造血细胞减少，非造血细胞比例增高，骨髓小粒空虚（有条件者做骨髓活检可见造血组织均匀减少）；④除外引起全血细胞减少的疾病，如 PNH Fanconi 贫血、Evans 综合征、免疫相关性全血细胞减少等（B错）。缺铁性贫血骨髓象增生活跃或明显活跃，有“核老浆幼”现象（C错）。海洋性贫血多因某个或多个珠蛋白基因异常引起一种或一种以上珠蛋白肽链合成减少或缺乏，导致珠蛋白链比例失衡，引起正常血红蛋白合成不足和过剩的珠蛋白肽链在红细胞内聚集形成不稳定产物（D错）。急性白血病的诊断标准为FAB 分型将原始细胞>骨髓有核细胞 (ANC)30% （E错）。